关于获得性膜下列哪项是错误的
A. 其数量与龋病发生呈负相关
B. 作为扩散屏障，对釉质面起修复和保护作用
C. 影响细菌在牙面黏附
D. 作为细菌代谢的底物和营养来源

正确答案：A。其数量与龋病发生呈负相关

解析：本题考查获得性膜。获得性膜指唾液蛋白或糖蛋白吸附至牙面所形成的生物膜，其数量与龋病发生呈正相关（A错，为本题的正确答案），获得性膜的数量越多，有越多的细菌聚集于其上，越易发生龋病。获得性膜作为扩散屏障，对釉质面起修复和保护作用（B对），可促进釉质矿化、防止被酸蚀。获得性膜影响细菌在牙面黏附（C对），在一些情况下附着增加，另一些情况下附着减少，这取决于微生物类型和表面的类型。获得性膜作为细菌代谢的底物和营养来源（D对），可为细菌的代谢提供糖等代谢原料。